无排卵性功能失调性子宫出血在临床上最常见的症状是
A. 月经周期紊乱
B. 子宫不规则出血
C. 经期长短不一
D. 大量出血
E. 出血量时多时少

正确答案：B。子宫不规则出血